肝癌的临床表现中，提示属晚期的表现是
A. 腹胀乏力
B. 肝区疼痛
C. 食欲不振
D. 肝区肿块
E. 体重下降

正确答案：D。肝区肿块

解析：肝区肿块（D对）为中晚期肝癌最常见的主要体征，约占95%。乏力（A错）、消瘦（E错）、食欲减退（C错）、腹胀（A错）均为肝癌的早期表现。